以解肌清热为主要功用的方剂是
A. 麻杏石甘汤
B. 桂枝汤
C. 大青龙汤
D. 柴葛解肌汤
E. 九味羌活汤

正确答案：D。柴葛解肌汤

解析：柴葛解肌汤的功用为解肌清热（D对），主治外感风寒，郁而化热证。方中柴胡、葛根解肌清热为君。羌活、白芷散表邪而止头痛；黄芩、石膏清泄里热。清药寒温并用，辛凉为主，共成解肌清热之剂。麻杏石甘汤以辛凉疏表，清肺平喘为主要功用（A错），主治外感风邪，邪热壅肺证。桂枝汤以解肌发表，调和营卫为主要功用（B错），主治外感风寒表虚证。大青龙汤以发汗解表，兼清里热为主要功用（C错），主治外感风寒，内有郁热证；溢饮。九味羌活汤以发汗祛湿，兼清里热为主要功用（E错），主治外感风寒湿邪，内有蕴热证。